关于TCR的叙述，不正确的是
A. 可识别抗原肽
B. 是T细胞表面的特有标志
C. 识别自身MHC分子的多态性部分
D. 影响T细胞的激活程度
E. 主要识别游离可溶性抗原

正确答案：E。主要识别游离可溶性抗原

解析：TCR不能直接识别抗原表位，只能识别抗原提呈细胞或靶细胞表面的抗原肽-MHC分子复合物。TCR既识别抗原肽，也识别自身MHC分子的多态性部分。TCR识别自身MHC分子的多态性部位也是T细胞识别抗原具有自身MHC限制性的原因，也影响T细胞的激活程度。掌握“B淋巴细胞”知识点。